氯吡格雷导致的溃疡和出血可选用
A. 右雷佐生
B. 奥美拉唑
C. 雷尼替丁
D. 维生素B₆
E. 维生素K₁

正确答案：B。奥美拉唑

解析：本题考查奥美拉唑的应用。奥美拉唑（B对）与氢氯吡格雷同服，可抑制其转换为活性代谢物，使氯吡格雷不能发挥作用。